女，30岁，不慎摔伤左脚踝部，疼痛，肿胀。査体：踝部压痛，无反常运动。下列处理不正确的是
A. 立即按摩
B. 冰敷
C. 固定踝部
D. 患肢抬高
E. 夹板固定

正确答案：A。立即按摩

解析：青年女性患者，不慎摔伤左脚踝部，疼痛，肿胀（扭伤表现）。査体：踝部压痛，无反常运动（排除骨折），故患者考虑诊断为踝部扭伤，立即按摩（A错，为本题正确答案）会加快患处的血液循环，使患处疼痛，肿胀更明显，故其处理是不正确的。冰敷（B对）、患肢抬高（D对）可以减少局部出血及肿胀。固定踝部（C对）、夹板固定（E对）可以减少损伤，有利于恢复。